多剂量静脉注射给药的平均稳态血药浓度是
A. 重复给药达到稳态后，一个给药间隔时间内血药浓度-时间曲线下面积除以给药时间间隔的商值
B. Css max与Css min的算术平均值
C. Css max与Css min的几何平均值
D. 药物的血药浓度-时间曲线下面积除以给药时间的商值
E. 重复给药的第一个给药间隔时间内血药浓度-时间曲线下面积除以给药间隔的商值

正确答案：A。重复给药达到稳态后，一个给药间隔时间内血药浓度-时间曲线下面积除以给药时间间隔的商值

解析：本题考查平均稳态血药浓度。重复给药达到稳态后，一个给药间隔时间内血药浓度-时间曲线下面积除以给药时间间隔的商值（A对）为平均稳态血药浓度，它用符号“Css”表示。